关于人免疫缺陷病毒的特点，哪项是错误的
A. 传染源是HIV携带者和AIDS患者
B. 引起人类艾滋病
C. 可通过性行为传播
D. 不能经胎盘传播
E. 可通过输血传播

正确答案：D。不能经胎盘传播

解析：HIV病毒的传播途径为：垂直传播（通过胎盘、产道、哺乳传播）；可通过血液传播；通过高危性行为传播。掌握“人类免疫缺陷病毒”知识点。